三羧酸循环的关键酶
A. 异柠檬酸脱氢酶
B. 丙酮酸激酶
C. 6-磷酸葡糖激酶
D. 琥珀酸脱氢酶
E. 苹果酸脱氢酶

正确答案：A。异柠檬酸脱氢酶

解析：在三羧酸循环中，有3个关键酶，分别是柠檬酸合酶、异柠檬酸脱氢酶和a-酮戊二酸脱氢酶复合体（A对）。（P93）己糖激酶（葡糖激酶）、磷酸果糖激酶-1和丙酮酸激酶（B错）催化，它们反应速率最慢，是控制糖酵解流量的3个关键酶。（P99）琥珀酸脱氢生成延胡索酸反应由琥珀酸脱氢酶催化（D错）。在苹果酸脱氢酶催化下，苹果酸脱氢生成草酰乙酸（E错）。